可用于治疗痤疮的药物是
A. 雌二醇
B. 他莫昔芬
C. 甲地孕酮
D. 米非司酮
E. 二甲双胍

正确答案：A。雌二醇

解析：本题考查痤疮治疗药。可用于治疗痤疮的药物是雌二醇（A对）。雌二醇为雌激素类药物，雌激素能抑制雄激素分泌，且有抗雄激素作用，可用于痤疮治疗。他莫昔芬（B错）为抗雌激素类药，用于绝经期后呈进行性发展的乳腺癌治疗。甲地孕酮（C错）为孕激素类药，主要用于激素替代治疗和避孕。米非司酮（D错）为避孕药，临床上用于抗早孕和房事后紧急避孕。二甲双胍（E错）为口服降糖药。